下列不属于食物强化目的的是
A. 弥补某些食品天然营养成分的缺陷
B. 补充食品加工损失的营养素
C. 改善食物的口感和性状
D. 达到特定目的的营养需要
E. 特殊人群预防需要

正确答案：C。改善食物的口感和性状